系统提出用酸收法治疗泄泻的医家是
A. 张仲景
B. 李东垣
C. 朱丹溪
D. 张景岳
E. 李中梓

正确答案：E。李中梓

解析：张仲景将泄泻与痢疾统称为下利（A错）。李东垣强调内伤脾胃，确立升阳除湿大法，善用风药（B错）。朱丹溪认为泄泻的病因主要有湿、火、气虚、痰积、食积（C错）。张景岳提出了分利之法治疗泄泻的原则（D错）。李中梓提出了著名的治泻九法，即淡渗、升提、清凉、疏利、甘缓、酸收、燥脾、温肾、固涩，在治疗上有了较大的发展（E对）。